下列药物中，具有严重的心脏毒性的药物是
A. 氟尿嘧啶
B. 甲氨蝶呤
C. 多柔比星
D. 丝裂霉素
E. 放线菌素

正确答案：C。多柔比星

解析：本题考查多柔比星的不良反应。下列药物中，具有严重的心脏毒性的药物是多柔比星（C对）。氟尿嘧啶（A错）的不良反应为胃肠道反应，比如出现恶心、腹泻等。甲氨蝶呤（B错）的不良反应为胃肠道反应、骨髓抑制、肝损害等。丝裂霉素（D错）的不良反应为骨髓抑制、恶心呕吐等。放线菌素（E错）的不良反应为食欲下降、恶心呕吐等。